在全口义齿正中（牙合）早接触的选磨时，根据BULL法则可以调改
A. 上后牙舌尖舌斜面
B. 上后牙舌尖颊斜面
C. 下后牙颊尖颊斜面
D. 下后牙舌尖颊斜面
E. 下后牙舌尖近中斜面

正确答案：D。下后牙舌尖颊斜面

解析：本题考查正中咬合早接触的选磨。在全口义齿正中（牙合）早接触的选磨时，根据BULL法则可以调改上颌颊尖的舌斜面和下颌后牙舌尖的颊斜面（D对ABC错）；前伸（牙合）时有干扰，根据BULL法则可以调改上牙颊尖远中斜面和下颌舌尖近中斜面（E错）。